在两样本均数比较的假设检验中，若α=0.05，P＞0.05，则
A. 尚不能认为两总体均数不等
B. 可认为两总体均数不等
C. 尚不能认为两样本均数不等
D. 可认为两样本均数不等
E. 还不能作出结论

正确答案：A。尚不能认为两总体均数不等